女，36岁。既往体健。在春节乘长途汽车回家的路上突然感到心前区发闷、呼吸困难，出汗，觉得自己就要不行了，自己不能控制自己，自己要发疯了。为此感到紧张、害怕。被紧急送到医院急诊，未做特殊处理，半小时后症状消失。患者长期治疗应首选的药物是
A. 多塞平
B. 地西泮
C. 帕罗西汀
D. 奥氮平
E. 苯乙肼

正确答案：C。帕罗西汀